骨折线从鼻骨通过眶内下、眶底、颧骨下方向后达翼突为
A. LeFortⅠ型
B. LeFortⅡ型
C. LeFortⅢ型
D. 颅前窝骨折
E. 颅中窝骨折

正确答案：B。LeFortⅡ型

解析：本题考查上颌骨骨折。骨折线从鼻骨通过眶内下、眶底、颧骨下方向后达翼突为LeFortⅡ型（B对）。LeFortⅡ型：骨折线从鼻骨通过眶内下、眶底、经眶下缘、颧骨下方向后达翼突。